女，50岁。牙龈增生影响咀嚼一年。检查见全口牙龈肥大增生，覆盖牙面约1/2，结节状。探诊时有出血，个别牙龈增生严重处牙齿有移位。为了有助于诊断，最应该注意询问的病史为服药史，如果该患者进行过肾移植手术，并在一年中一直接受治疗，则最有可能的诊断是
A. 药物性牙龈增生
B. 牙龈纤维瘤病
C. 坏死性龈炎
D. 快速进展性牙周炎
E. 白血病的牙龈病损

正确答案：A。药物性牙龈增生

解析：本题考查药物性牙龈肥大的病因及临床表现。与药物性牙龈增生有关的三类常用药物是：抗癫痫药—苯妥英钠、免疫抑制剂—环孢素、钙通道阻滞剂。肾移植患者需要服用免疫抑制剂—环孢素，环孢素服药者有30%～50%发生牙龈纤维性增生。根据病例所述，牙龈呈结节状，覆盖牙面约1/2，个别牙龈增生严重处牙齿有移位，再结合免疫抑制剂这一用药史，则最有可能的诊断为药物性牙龈增生（A对）。牙龈纤维瘤病（B错）牙龈增生范围广、程度重，常覆盖牙冠的2/3以上，且与免疫抑制剂服用无关。坏死性龈炎（C错）是指发生于龈炎和龈乳头的坏死，病例中所述为牙龈增生。快速进展性牙周炎（D错）主要表现为牙周组织的快速进展性破坏，牙周袋形成，牙槽骨吸收，牙龈红肿出血明显，牙龈增生比较少见。白血病的牙龈病损（E错）主要表现为牙龈肿大，龈缘处组织坏死、溃疡和假膜形成，龈缘渗血等症状，牙龈增生少见。